在牙周炎发展中具有致炎和抗炎双作用的是
A. 菌斑生物膜
B. 结合上皮分泌的防御素
C. 牙牙合创伤
D. 食物嵌塞
E. 龈沟液分泌的PMN

正确答案：E。龈沟液分泌的PMN

解析：本题考查牙周组织。在牙周炎发展中具有致炎和抗炎双作用的是（E对）。龈沟液具有以下作用：①通过GCF流冲洗龈沟内的外来物质；②含有可以促进上皮附着于牙面的血浆蛋白；③具有抗微生物的特异性抗体；④在牙龈防御机制中，其所含补体可促进抗体的活化；⑤能提供龈下细菌丰富的营养成分；⑥提供牙石矿化的物质。龈沟液在牙龈组织的防御体系中起着重要作用，研究龈沟液的量及内容的变化，对了解牙周疾病的发生机制、病情变化及治疗效果等均有重要意义。菌斑生物膜（A错）：指黏附在牙齿表面或口腔其他软组织上的微生物群，是由大量细菌、细胞间物质、少量白细胞、脱落上皮细胞和食物残屑等组成，不能轻易通过漱口或用水冲洗的方法去除。单独存在时，牙龈组织炎症不受影响。结合上皮分泌的防御素（B错）：结合上皮在抗菌防御中不仅具有上皮屏障的作用，而且结合上皮细胞本身能产生有效的抗菌物质，包括防御素和溶酶体酶。被微生物产物激活的上皮细胞能分泌趋化因子如白细胞介素，细胞因子如白细胞介素-1和白细胞介素-6，及肿瘤坏死因子α，它们吸引并激活专门的防御细胞如淋巴细胞和中性粒细胞。牙牙合创伤（C错）：牙周炎的始动因子是细菌，疾病的本质是炎症导致的牙周组织破坏，而炎症扩展至牙周支持组织的途径和破坏的程度，则在一定程度上受咬合力的影响，因此，牙合创伤是一个重要的局部促进因素，可引起牙齿松动，但骨吸收的表现不同于其他。食物嵌塞（D错）：在咀嚼过程中，食物被咬合压力楔入相邻两牙的牙间隙内，称为食物嵌塞。食物嵌塞是导致局部牙周组织炎症和破坏的常见原因之一。由于嵌塞物的机械刺激作用和细菌的定植，除引起牙周组织的炎症外，还可引起牙龈退缩、龈乳头炎、邻面龋、牙槽骨吸收和口臭等。食物嵌塞可以引起龈炎和牙周炎，也可以加重牙周组织原已存在的病理变化。